成人重度肥胖是指体重至少超过标准体重的
A. 0.3
B. 0.4
C. 0.5
D. 0.1
E. 0.2

正确答案：C。0.5

解析：肥胖度≥10%为超重（D错），20%～29%为轻度肥胖（E错），30%～49%为中度肥胖（AB错），≥50%为重度肥胖（C对）。